酸枣仁的主要功效是
A. 补中益气、养血安神
B. 益气健脾、补肾安神
C. 养心、安神、敛汗
D. 生津、安神、益智
E. 补肝肾、涩精、敛汗

正确答案：C。养心、安神、敛汗

解析：本题考查的是酸枣仁的功效。酸枣仁的主要功效是养心、安神、敛汗（C对）。酸枣仁：【功效】养心安神，敛汗。大枣：【功效】补中益气，养血安神（A错），缓和药性。刺五加：【功效】补气健脾，益肾强腰，养心安神（B错），活血通络。人参：【功效】大补元气，补脾益肺，生津止渴，安神益智（D多）。山茱萸：【功效】补益肝肾，收敛固脱（E错）。